可导致输血反应的天然抗体类型是
A. IgM
B. IgG
C. IgD
D. IgE
E. IgA

正确答案：A。IgM

解析：可导致输血反应的天然抗体类型是IgM（A对）。ABO血型抗体有“天然抗体”与“免疫性抗体”之分。所谓“天然抗体”是指没有可察觉的免疫刺激，而“天然”存在于人体内血清中。这些刺激源，如细菌，广泛分布于自然环境，它可以存在于灰尘、食物及各种物体，所以在通常情况下不会被人察觉。由于很多细菌有类似于人类HAB抗原的抗原性，因此对人体是一种强有力且持续不断可免疫的刺激。在这种外来刺激情况下，人体将产生对这些异己的HAB抗原的同种抗体。而“免疫性抗体”则是指经A或B抗原特异性免疫刺激产生的抗A或抗B抗体，这种抗体来自母胎ABO血型不合的妊娠，输入了ABO血型不合的红细胞或注射了纯化的血型物质及含有血型活性物质的病毒或细菌产物等。“天然抗体”多趋向于IgM，而“免疫性抗体”则常是IgG。